高效液相色谱仪的组成部分包括
A. 热导检测器
B. 六通进样阀
C. 紫外检测器
D. 高压输液泵
E. 色谱柱

正确答案：B、C、D、E。六通进样阀；紫外检测器；高压输液泵；色谱柱